随胆汁排泄的药物或其代谢产物，在小肠中转运期间又会被重新吸收返回门静脉的现象是
A. 肠肝循环
B. 反向吸收
C. 清除率
D. 膜动转运
E. 平均滞留时间

正确答案：A。肠肝循环

解析：本题考查肝肠循环。肠肝循环（A对）是指随胆汁排入十二指肠的药物或其代谢物，在肠道中重新被吸收，经门静脉返回肝脏，重新进入血液循环的现象；清除率（C错）表示肾在单位时间(每分钟)内能将多少毫升血浆中所含的某些物质完全清除；膜动转运（D错）指通过细胞膜的主动变形将药物摄入细胞内或从细胞内释放到细胞外的转运过程；平均滞留时间（E错）是药物分子在体内停留的平均时间。